O/W乳膏剂中常用的防腐剂是
A. 月桂醇硫酸钠
B. 羊毛脂
C. 丙二醇
D. 羟苯乙酯
E. 凡士林

正确答案：D。羟苯乙酯

解析：本题考查乳膏剂的基质与附加剂。羟苯乙酯（D对）为常用的防腐剂；月桂醇硫酸钠（A错）为乳膏剂常用的乳化剂；羊毛脂（B错）是W/O型乳膏剂常用的乳化剂；甘油（C错）是很好的保湿剂；凡士林（E错）是乳膏剂常用的油性基质。